根头略膨大，可见暗绿色或暗棕色轮状排列的叶柄残基和密集的疣状突起的药材是
A. 西洋参
B. 北豆根
C. 三七
D. 板蓝根
E. 三棱

正确答案：D。板蓝根

解析：本题考查的是板蓝根的性状鉴别。根头略膨大，可见暗绿色或暗棕色轮状排列的叶柄残基和密集的疣状突起的药材是板蓝根（D对）。板蓝根【性状鉴别】药材呈圆柱形，稍扭曲，长10～20cm，直径0.5～1cm。表面淡灰黄色或淡棕黄色，有纵皱纹、横长皮孔样突起及支根痕。根头略膨大，可见暗绿色或暗棕色轮状排列的叶柄残基和密集的疣状突起。西洋参（A错）【性状鉴别】药材呈纺锤形、圆柱形或圆锥形，长3～12cm，直径0.8～2cm。表面浅黄褐色或黄白色，可见横向环纹及线形皮孔状突起，并有细密浅纵皱纹及须根痕。北豆根（B错）【性状鉴别】药材呈细长圆柱形，弯曲，有分枝，长可达50cm，直径0.3～0.8cm。表面黄棕色至暗棕色，多有弯曲的细根，并可见突起的根痕和纵皱纹，外皮易剥落。质韧，不易折断，断面不整齐，纤维细，木部淡黄色，呈放射状排列，中心有髓。三七（C错）【性状鉴别】药材主根呈类圆锥形或圆柱形，长1～6cm，直径1～4cm。表面灰褐色或灰黄色，有断续的纵皱纹和支根痕。顶端有茎痕，周围有瘤状突起。三棱（E错）【性状鉴别】药材呈圆锥形，略扁，长2～6cm，直径2～4cm。表面黄白色或灰黄色，有刀削痕，须根痕小点状，略呈横向环状排列。